L型钙离子通道中的主要功能亚单位是
A. α₁
B. α₂
C. β
D. γ
E. δ

正确答案：A。α₁